发生乳头皲裂的常见原因是
A. 催乳激素
B. 催产素
C. 哺乳方法不当
D. 让新生儿早吸吮多吸吮母乳
E. 喂乳前消毒乳头

正确答案：C。哺乳方法不当

解析：催乳素的作用是促进乳汁合成（A错）。催产素的作用是促进乳腺发育（B错）。乳头皲裂主要是因为喂养方法不当而导致（C对）。于产后半小时内开始哺乳，此时乳房内乳量虽少，可通过新生儿吸吮动作刺激泌乳（D错）；哺乳前应洗手并用温开水清洁乳房及乳头（E错）。催乳激素（A错）和催产素（B错）均与乳汁产生有关，不会导致乳头皲裂。